男性，60岁，因胃溃疡合并多次大出血，行胃大部切除术。该病人术后可能出现的营养性并发症不包括
A. 体重减轻
B. 低血糖综合征
C. 缺铁性贫血
D. 骨质疏松
E. 隐性骨质软化

正确答案：B。低血糖综合征

解析：胃大部切除术后，由于术中操作不当和解剖、生理改变，病人可出现多种并发症，按发生的时间顺序可分为早期并发症和晚期并发症。晚期并发症主要包括倾倒综合征、碱性反流性胃炎、溃疡复发、营养性并发症和残胃癌等。倾倒综合征指胃大部切除术后，由于失去了幽门的节制功能，导致胃内容物排空过快而产生的一系列临床症状，可分为早期倾倒综合征和晚期倾倒综合征。晚期倾倒综合征又称低血糖综合征（B错，为本题正确答案），为食物进入肠道后刺激胰岛素大量分泌而导致的反应性低血糖。